血型不合输血后，病人出现严重溶血反应，实验室检查的重要依据是
A. 含铁血黄素尿
B. 血尿
C. 血红蛋白尿
D. 网织红细胞增高
E. 尿胆原（+）

正确答案：C。血红蛋白尿

解析：血红蛋白尿（C对）是指被破坏的红细胞释放出的血红蛋白进入尿液排出，因此血红蛋白尿提示出现血管内溶血。反复血管内溶血时，铁以铁蛋白或含铁血黄素的形式沉积在上皮细胞内并可随尿排出，形成含铁血黄素尿。因此含铁血黄素尿（A错）常提示慢性反复血管内溶血。血尿（B错）见于泌尿系统炎症、结石、结核、肿瘤等疾病，也可见于血友病、血小板减少性紫癜，但溶血一般不出现。网织红细胞增高（D错）提示骨髓活跃度增高，造血功能旺盛，主要见于慢性贫血。尿胆原是由结合胆红素在肠道内转化而来，尿胆原（+）（E错）说明结合胆红素升高，不仅见于溶血性黄疸，也可见于肝细胞性黄疸。